既补益精血，又解毒截疟的药是
A. 肉苁蓉
B. 山药
C. 何首乌
D. 石斛
E. 麦冬

正确答案：C。何首乌

解析：本题考查的是何首乌的功效。既补益精血，又解毒截疟的药是何首乌（C对）。何首乌：【功效】补益精血，解毒，截疟，润肠通便。肉苁蓉（A错）：【功效】补肾阳，益精血，润肠通便。山药（B错）：【功效】益气养阴，补脾肺肾，固精止带。石斛（D错）：【功效】养胃生津，滋阴除热，明目，强腰。麦冬（E错）：【功效】润肺养阴，益胃生津，清心除烦，润肠通便。